三羧酸循环的中间产物是
A. HMG-CoA
B. 乙酰CoA
C. 琥珀酰CoA
D. 丙酰CoA
E. 丙二酰CoA

正确答案：C。琥珀酰CoA

解析：三羧酸循环的第二次氧化脱羧反应是α-酮戊二酸氧化脱羧生成琥珀酰CoA（C对），反应不可逆，是三羧酸循环的第三个限速步骤（P121）。HMG-CoA（A错）和乙酰CoA（B错）是脂肪酸在肝内β-氧化生成酮体的中间产物，不参与三羧酸循环（P158）。丙酰CoA（D错）虽可经β-羧化酶及异构酶作用，转变为琥珀酰CoA，进入三羧酸循环彻底氧化，但其本身并不是三羧酸循环的中间产物（P158）。乙酰CoA在乙酰CoA羧化酶的催化下转化成丙二酰CoA（E错）是软脂酸合成的第一步反应，不参与三羧酸循环（P151）。